女，56岁。近3个月来常感头晕目眩，记忆力明显减退，情绪低落，对事情不感兴趣。最需要进行检査
A. 头颅MRI
B. 抑郁自评量表
C. 焦虑自评量表
D. CT检查
E. 骨髓穿刺

正确答案：B。抑郁自评量表

解析：该患者近3个月来常以情绪低落为主要表现，对事情不感兴趣，故诊断为抑郁发作。最需要进行抑郁自评量表，主要用于评定抑郁患者的病情严重程度（B对）。焦虑自评量表主要用于评定焦虑患者的病情严重程度（C错）。